婴儿颅内压增高，按诊的主要部位是
A. 头颅
B. 胸胁
C. 腹部
D. 皮肤
E. 四肢

正确答案：A。头颅

解析：囟填(充满)--反映颅内压增高，多见于热炽气营之脑炎、脑膜炎等（A对BCDE错）。